患者，女，27岁，妊娠20周，出现发热，体温最高达38.5℃，体格检查：肾区叩痛，经相关实验室检查，诊断为急性肾盂肾炎，宜选用的药物是
A. 甲硝唑
B. 头孢噻肟钠
C. 阿米卡星
D. 阿奇霉素
E. 诺氟沙星

正确答案：B。头孢噻肟钠

解析：本题考查治疗急性肾盂肾炎的药物。治疗急性肾盂肾炎，宜选用的药物是头孢噻肟钠（B对）。甲硝唑（A错）可用于治疗滴虫性阴道炎。阿米卡星（C错）肾毒性大，应慎用。阿奇霉素（D错）用于非多种耐药淋病奈瑟菌所致的尿道炎和宫颈炎。诺氟沙星（E错）用于敏感菌所致的尿路感染、淋病、前列腺炎、肠道感染。